"察言观色"、"听话听音"、"善解人意"主要是指
A. 要有一颗帮助别人的心
B. 要有一个敏锐的观察力
C. 要遵守职业道德
D. 每天要具备好的心情
E. 要有丰富的生活经验和知识

正确答案：B。要有一个敏锐的观察力

解析：心理治疗师需要有一个敏锐的观察力，即善于"察言观色"、"听话听音"、"善解人意"，这些能力的培养十分重要。掌握“心理治疗原则、主要方法及应用”知识点。